薤白的主治病证是
A. 肝胃不和之脘痛
B. 肝郁气滞之胁痛
C. 肾不纳气之虚喘
D. 痰湿壅肺之咳嗽气喘
E. 痰浊闭阻胸阳之胸痹

正确答案：E。痰浊闭阻胸阳之胸痹

解析：本题考查的是薤白的主治病证。薤白的主治病证是痰浊闭阻胸阳之胸痹证（E对）。薤白：【主治病证】（1）痰浊闭阻胸阳之胸痹证。（2）胃肠气滞，泻痢里急后重。川楝子：【主治病证】（1）肝气郁滞或肝胃不和之胸胁、脘腹胀痛（AB错），疝气痛。（2）虫积腹痛。（3）头癣。沉香：【主治病证】（1）寒凝气滞之胸腹胀闷作痛。（2）胃寒呕吐。（3）下元虚冷、肾不纳气之虚喘（C错），痰饮咳喘属上盛下虚者。陈皮：【主治病证】（1）脾胃气滞之脘腹胀满或疼痛、嗳气、恶心呕吐。（2）湿浊中阻之胸闷腹胀、纳呆便溏。（3）痰湿壅肺之咳嗽气喘（D错）。